下列各项，对白细胞减少症有诊断意义的是
A. 外周血中性粒细胞绝对值低于2.0×10⁹/L
B. 外周血白细胞数低于4×10⁹/L
C. 外周血白细胞数低于5×10⁹/L
D. 外周血中性粒细胞绝对值低于0.5×10⁹/L
E. 骨髓检查巨核细胞明显减少

正确答案：B。外周血白细胞数低于4×10⁹/L

解析：外周血白细胞数持续低于正常值（成人4.0×10⁹/L）时称为白细胞减少（B对），（C错）。当中性粒细胞绝对数低于2×10/L时称为粒细胞减少症（A错）；低于0.5×10⁹/L时称为粒细胞缺乏症。中性粒细胞数减少的程度与感染的危险性有明显相关：中性粒细胞在1.0×10⁹/L～2.0×10⁹/L时，容易感染；低于0.5×10⁹/L时具有很大的感染危险性（D错）。再生障碍性贫血，急性白血病及其他骨髓浸润或破坏的疾病，以及急性感染，化学物或药物中毒，放射病等均有可能引起骨髓里的巨核细胞减少（E错）。